吸入麻醉，应首选
A. 普鲁卡因
B. 乙醚
C. 利多卡因
D. 硫喷妥钠
E. 丁哌卡因

正确答案：B。乙醚

解析：常用的吸入麻醉药有乙醚，氟烷，甲氧氟烷，安氟醚，异氟醚，氧化亚氮，乙醚的优点是麻醉征象易于辨认，麻醉深度易于调节，安全范围广。对呼吸和循环抑制较轻。肌松作用良好。镇痛作用强。使用设备简单，适用于任何年龄的各型手术（B对）。普鲁卡因（A错）、利多卡因（C错）为局部麻醉常用药。硫喷妥钠（D错）是作用于中枢神经系统而产生全麻状态的药物称为静脉麻醉药。丁哌卡因（E错）为长效局部麻醉药。